患者，男，20岁。心悸不安，体弱气短，虚烦眠差，咽干口燥，舌淡少苔，脉结代。治疗应选用
A. 天王补心丹
B. 炙甘草汤
C. 归脾汤
D. 生脉散
E. 朱砂安神丸

正确答案：B。炙甘草汤

解析：本题考查常见的病症的辩证、处方。题中患者心悸不安，体弱气短，虚烦眠差，咽干口燥，舌淡少苔，脉结代，证属阴血阳气虚弱，心脉失养证。天王补心丹为安神剂, 具有滋阴清热，养血安神之功效。主治阴虚血少，神志不安证。心悸怔忡，虚烦失眠，神疲健忘，或梦遗，手足心热，口舌生疮，大便干结，舌红少苔，脉细数（A错）。炙甘草汤，别名复脉汤。为补益剂，具有益气滋阴，通阳复脉之功效。主治阴血阳气虚弱，心脉失养证。脉结代，心动悸，虚羸少气，舌光少苔，或质干而瘦小者；虚劳肺痿。干咳无痰，或咳吐涎沫，量少，形瘦短气，虚烦不眠，自汗盗汗，咽干舌燥，大便干结，脉虚数（B对）。归脾汤为补益剂，具有益气补血，健脾养心之功效。主治心脾气血两虚证。心悸怔忡，健忘失眠，盗汗，体倦食少，面色萎黄，舌淡，苔薄白，脉细弱；脾不统血证。便血，皮下紫癜，妇女崩漏，月经超前，量多色淡，或淋漓不止，舌淡，脉细弱（C错）。生脉散为补益剂，具有益气生津，敛阴止汗之功效。主治温热、暑热、耗气伤阴证。汗多神疲，体倦乏力，气短懒言，咽干口渴，舌干红少苔，脉虚数（D错）。朱砂安神丸为安神剂，具有镇心安神，清热养血之功效。主治心火亢盛，阴血不足证。失眠多梦，惊悸怔忡，心烦神乱：或胸中懊侬，舌尖红，脉细数。临床常用于治疗神经衰弱所致的失眠、心悸、健忘，精神忧郁症引起的神志恍惚，以及心脏早搏所致的心悸、怔忡等属于心火亢盛，阴血不足者（E错）。